必须在广告中注明“本广告仅供药学专业人士阅读”的药品是
A. 氯雷他定片（OTC）
B. 艾司唑仑片
C. 阿奇霉素分散片（抗菌药）
D. 曲马多片
E. 复方樟脑酊（医院制剂）

正确答案：C。阿奇霉素分散片（抗菌药）

解析：本题考查药品广告管理。阿奇霉素（C对）为处方药，处方药广告必须注明：“本广告仅供医学药学专业人士阅读”。